蛇伤急救中，最早的治疗方法是
A. 早期结扎
B. 冲洗
C. 烧灼
D. 服蛇伤药
E. 扩创

正确答案：A。早期结扎

解析：蛇咬伤后应当避免奔跑，现场立即以布带等物绑扎伤肢的近心端，松紧度掌握在能够使被绑扎的下部肢体动脉搏动稍微减弱为宜（A对）。绑扎后每隔30分钟左右松解一次，每次1-2分钟，以免影响血液循环造成组织坏死。同时可以外敷清热解毒的草药，如半边莲、蒲公英、芙蓉叶等，适用于肿胀较重者，可选择1-2种捣烂敷于伤口周围肿胀部位。